近致癌物是指
A. 代谢活化成终致癌物过程的中间代谢产物
B. 不经代谢活化即有致癌活性的物质
C. 需经代谢活化才有致癌活性的物质
D. 兼有引发（启动）、促长、进展作用的物质
E. 经代谢转化最后产生的有致癌活性的代谢产物

正确答案：A。代谢活化成终致癌物过程的中间代谢产物